不属突发公共卫生事件的分类的是
A. 重大传染病疫情
B. 重大食物中毒和职业病
C. 个别医疗事故伤亡
D. 其他严重影响公众健康的事件
E. 群体性不明原因疾病

正确答案：C。个别医疗事故伤亡

解析：个别医疗事故伤亡（C错，为本题正确答案）是个体的医疗事故事件，不符合突发公共卫生事件严重损害社会公众健康的定义。突发公共卫生事件，是指突然发生，造成或者可能造成社会公众健康严重损害的重大传染病疫情（A对）、群体性不明原因疾病（E对）、重大食物中毒和职业病（B对）以及其他严重影响公众健康的事件（D对）。